女，36岁。乏力，头晕，Hb64g/L，检查提示红细胞体积减少，中间淡染区扩大。则最可能出现的结果是
A. 细胞内血红蛋白减少
B. 血液内转铁蛋白增加
C. 骨髓内铁没有变化
D. 总铁结合力增强，铁蛋白减少
E. 总铁结合力增强，铁蛋白增加

正确答案：D。总铁结合力增强，铁蛋白减少

解析：患者中年女性，头晕、乏力（贫血表现），Hb为64g/L（成年女性正常值大于110g/L），提示有贫血，检查示红细胞体积减少，中间淡染区扩大，考虑为缺铁性贫血。缺铁性贫血铁代谢指标特征性变化为总铁结合力增高、铁蛋白会减少（D对E错）、血清铁和转铁蛋白饱和度减低等。缺铁性贫血时首先出现的变化是贮存铁如血清铁蛋白、骨髓内铁减少（C错），当贮存铁减少到不足以补偿功能状态的铁时，才会逐渐出现血液内转铁蛋白增加（B错）、总铁结合力增强（反映转铁蛋白的指标）、细胞内血红蛋白减少（A错）而表现为典型的小细胞低色素性贫血。总铁结合力增高、铁蛋白会减少、血液内转铁蛋白增加、细胞内血红蛋白减少均可出现，但最佳选项为总铁结合力增高、铁蛋白会减少（D对）。